耳、肾毒性最低的氨基苷类药物是
A. 卡那霉素
B. 庆大霉素
C. 西索米星
D. 奈替米星
E. 新霉素

正确答案：D。奈替米星